适用于含有大量淀粉、树胶、果胶、黏液质的中药提取方法是
A. 浸渍法
B. 水蒸气蒸馏法
C. 煎煮法
D. 回流提取法
E. 连续回流提取法

正确答案：A。浸渍法